患儿，女，3岁。低热恶寒，鼻塞流涕，全身皮肤成批出疹，为红色斑疹和斑丘疹，继有疱疹，疱浆清亮，头面、躯干多见，舌红苔薄白，脉浮数。其诊断是
A. 风疹，邪郁肺卫证
B. 麻疹，见形期
C. 幼儿急疹，肺卫蕴热证
D. 猩红热，邪侵肺胃证
E. 水痘，风热轻证

正确答案：E。水痘，风热轻证

解析：水痘为小儿常见急性出疹性传染病，临床特征为发热，皮肤黏膜分批出现的瘙痒性斑、丘、疱疹及结痂，且上述各期皮疹可同时存在。据本病例皮疹特点，可诊断为水痘。外感风热时邪，伤及肺卫，故低热恶寒，鼻塞流涕，舌红苔薄白，脉浮数；邪透肌表，故可见全身皮肤成批出疹，为红色斑疹和斑丘疹，继有疱疹，疱浆清亮，头面、躯干多见，故其证候邪郁肺卫证，与风热轻证（老版教材提法）意义相同，故诊断为水痘之风热轻证（邪郁肺卫证）（E对）。风疹（其特点：出疹迅速，消退快，并伴有耳后、颈部、枕后淋巴结肿大并触痛），邪郁肺卫证（A错）其临床以发热恶风，轻微咳嗽，疹色淡红，稀疏细小，分布均匀为特征。麻疹，见形期（B错）临床以发热起伏如潮，疹随外出，咳嗽加剧，烦渴，大便干结为特征。幼儿急疹（以持续高热3～5天，热退疹出为临床特点），肺卫蕴热证（新教材表述为邪郁肌表证）（C错）临床以突然高热，持续3～5天，一般情况良好为特征。猩红热，邪侵肺胃证（新教材表述为邪侵肺卫证）（D错）临床以发热，咽部红肿疼痛，常影响吞咽，皮肤潮红，丹疹隐隐为特征。